痰饮患者，症见恶心呕吐、胃脘痞满者，属于
A. 痰浊上犯证
B. 痰阻心脉证
C. 痰气凝结证
D. 痰停于胃证
E. 痰浊阻络证

正确答案：D。痰停于胃证

解析：本题考查的是痰饮的致病特点。痰饮患者，症见恶心呕吐、胃脘痞满者，属于痰停于胃证（D对）。痰饮阻滞气血运行：痰饮为实邪，可随气流行全身，或停滞于经脉，或留滞于脏腑，阻滞气机，妨碍气血运行。若痰饮流注于经络（E错），则致经络气机阻滞，气血运行不畅，出现肢体麻木，屈伸不利，甚至半身不遂，或形成瘰疬痰核，阴疽流注等；若痰饮留滞于脏腑，则阻滞脏腑气机，使脏腑气机升降失常。如痰饮阻肺，肺气失于宣降，则见胸闷气喘，咳嗽吐痰等；痰饮停胃，胃气失于和降，则见恶心呕吐等；痰浊痹阻心脉（B错），血气运行不畅，可见胸闷心痛；无形之痰气结滞（C错）于咽喉，则形成“梅核气”，临床常见咽中梗阻如有异物，咽之不下，吐之不出，胸膈满闷，情绪低落，善太息等。痰浊上犯（A错）易于蒙蔽心神。痰饮为浊物实邪，而心神性清净。故痰浊为病，随气上逆，尤易蒙蔽清窍，扰乱心神，使心神活动失常，出现头晕目眩、精神不振等症，或者痰浊上犯，与风、火相合，蒙蔽心窍，扰乱神明，以至出现神昏谵妄，或引起癫、狂、痫等疾病。